男，38岁。因间断心悸1天就诊。查体：心率72次/分，偶可闻及期前收缩。心电图示：提前出现的P波，形态与窦性P波略有不同，P～R间期0.13秒，QRS波群形态正常，代偿间期不完全。最恰当的处理是
A. 静脉注射阿托品
B. 口服美托洛尔
C. 口服普罗帕酮
D. 寻找和去除病因
E. 口服胺碘酮

正确答案：D。寻找和去除病因

解析：患者青年男性，间断心悸，偶可闻及期前收缩，心率正常，心电图示：提前出现的P波，形态与窦性P波略有不同，P-R间期0.13秒（正常值0.12秒～0.20秒），QRS波群形态正常，代偿间期不完全，可诊断为房性期前收缩。患者并无明显临床症状，此时最恰当的处理是寻找和去除病因（D对），无需药物治疗。口服美托洛尔（B错）、口服普罗帕酮（C错）和口服胺碘酮（E错）主要是针对房性期前收缩患者有明显症状或因房性期前收缩触发室上性心动过速时。阿托品（A错）多用于治疗房室传导阻滞和严重心动过缓。